对非处方药在全民卫生保健中的作用，叙述不正确的是
A. 增强了人民群众的健康意识
B. 加快了医疗卫生制度的改革
C. 方便了广大群众的药品购买
D. 提高了民众科学文化的素质
E. 加速了执业医师队伍的建设

正确答案：E。加速了执业医师队伍的建设